材料四：某顾客持医院处方到药品零售企业购买处方药。药品零售企业工作人员对处方进行审核发现，处方所开药品已经售完，处方未注明用法用量，药品零售企业有同类药品，药品适应症与治疗目标相符，价格相对便宜。根据《处方管理办法》，对背景材料中处方未注明用法用量的情形，定性正确的是
A. 属于不规范处方
B. 属于用药不适宜处方
C. 属于超常处方
D. 属于合格处方

正确答案：A。属于不规范处方

解析：本题考查处方审核内容。处方的规范性审核包括药品剂量、规格、用法、用量准确清楚，不得使用“遵医嘱”“自用”等含糊不清字句等。本题处方中未注明用法用量的情形，属于不规范处方（A对）。